以下动脉，哪个不是上颌动脉的分支
A. 上牙槽动脉
B. 下牙槽动脉
C. 眶下动脉
D. 眼动脉
E. 脑膜中动脉

正确答案：D。眼动脉

解析：上牙槽动脉（A对）、下牙槽动脉（B对）、下牙槽动脉（C对）、脑膜中动脉（E对）均为上颌动脉的分支。眼动脉（D错，为本题正确答案）为颈内动脉的分支。